患者，女，24岁，已婚。产后1周，小腹隐隐作痛，喜按，恶露量少、色淡，头晕耳鸣，舌淡红苔薄白，脉虚细。其证候是
A. 气虚
B. 肾虚
C. 血虚
D. 虚寒
E. 脾肾两虚

正确答案：C。血虚

解析：患者产后一周，小腹隐隐作痛，喜按，恶露量少，色淡红，是为血少气弱，运行无力，血行迟涩，故小腹隐痛，喜揉按；营血亏虚，冲任血少则恶露量少，色淡红；并伴有面色苍白，头晕眼花，心悸怔忡等脉虚细等血虚之象（C对）。气虚证常见气短，乏力，神疲，脉虚之象（A错）。肾虚证又分肾阳虚证，常见腰膝酸冷，性欲减退，夜尿多；肾气虚证常见腰膝酸软，小便、精液、经带、胎气不固；肾阴虚常见腰酸而痛，遗精、经少、头晕耳鸣之象（B错）。虚寒常见畏冷，肢凉，口淡不渴，或喜热饮，或自汗，小便清长或乃尿少不利，大便稀薄，舌淡胖，苔白滑，脉沉迟无力之象（D错）。脾肾两虚常见久泻久痢、水肿、腰腹冷痛之象（E错）。